男孩，6岁。因智能发育落后就诊，头发呈金黄色，皮肤色白，时有抽搐，不伴发热，无腹泻。为协助诊断，应首选
A. 脑电图检查
B. Guthrie试验
C. 尿三氯化铁试验
D. 尿蝶呤分析
E. 血钙、磷检测

正确答案：C。尿三氯化铁试验

解析：在摄入中等量奶（苯丙氨酸的来源）以后至少48小时，所有新生儿都应进行苯丙酮尿症筛查，一般用Guthrie抑制试验，但此患儿为6岁（B错）。苯丙酮尿症是一种常见的氨基酸代谢病，常用尿三氯化铁试验进行筛查检测苯丙氨酸是否正常（C对）。根据该患儿智力落后、头发由黑变黄，特殊体征和血苯丙氨酸升高，排除四氢生物蝶呤缺乏症就可确诊为苯丙酮尿症，所以尿蝶呤图谱分析为鉴别诊断时的重要手段（D错）。维生素D缺乏性佝偻病引起的钙、磷代谢紊乱、骨骼发育障碍性疾病，所以血钙、磷检测为维生素D缺乏性佝偻病的检查手段（E错）。